成土母岩中含硒量相对较高的是
A. 沉积岩
B. 花岗岩
C. 变质岩
D. 冰晶岩
E. 火成岩

正确答案：A。沉积岩

解析：本题考查成土母岩中含硒量相对较高的岩类。土壤中硒含量高低与该地区成土母岩有关，沉积岩（A对BCD错）、页岩形成的土壤硒含量相对较高；火成岩（E错）所形成的土壤硒含量相对较低。